下列哪项属于妇女常见病筛查指标
A. 婚前医学检查率
B. 检出疾病率
C. 婚前卫生指导率
D. 随访率
E. 婚前卫生咨询率

正确答案：D。随访率

解析：本题考查妇女常见病筛查指标。妇女常见病筛查指标主要包括妇女常见病筛查率、妇女常见病患病率、妇女常见病治愈率、恶性肿瘤发病率、随访率（D对ABCE错）等。